患者虽已住院，但仍坚持工作，并提出要求提前出院。这种患者角色转变的类型为
A. 角色行为强化
B. 角色行为异常
C. 角色行为冲突
D. 角色行为减退
E. 角色行为缺如

正确答案：D。角色行为减退

解析：病人角色适应不良是指病人不能顺利地完成角色转换的过程。包括①角色行为缺如（E错）：病人未能进入病入角色，没有配合医疗活动恢复健康的想法与行为。虽然已做出疾病的诊断，但病人尚未意识到自己患病或不愿承认自己是个病人。②角色行为冲突（C错）：当多种社会地位和多种角色集于一人时，在其自身内部产生的冲突。在适应病人角色过程中，与病前的各种角色发生心理冲突，而引起行为的不协调。③角色行为减退（D对）：个体进入病人角色后，由于某种原因又重新承担起本应免除的社会角色的责任，放弃了病人角色去承担其他角色的活动。④角色行为强化（A错）: 随着躯体的康复，病人角色行为也应转化为正常的社会角色行为。如果这种转化发生阻碍，个体安于病人角色的现状，角色的行为与其疾病症状程度不吻合，对自我过度表示怀疑和忧虑，行为上表现出较强的退缩和依赖性，这就是病人角色行为强化。⑤角色行为异常（B错）: 这是病入角色适应中的一种特殊类型 。 病人无法承受患病或不治之症的挫折和压力，对病入角色感到厌倦、悲观、绝望，由此而导致行为异常。